主要利用食物中脂肪消化产物再合成甘油三酯
A. 肝细胞
B. 脂肪细胞
C. 小肠黏膜细胞
D. 肾脏黏膜细胞
E. 胆囊黏膜细胞

正确答案：C。小肠黏膜细胞

解析：小肠黏膜细胞主要利用食物中脂肪消化产物再合成甘油三酯，以乳糜微粒形式经淋巴进入血液循环。掌握“甘油磷脂、胆固醇和血脂蛋白代谢”知识点。